Caplan综合征是
A. 矽肺患者的并发症之一
B. 石棉肺的并发症之一
C. 煤矿工人尘肺的并发症之一
D. 铸工尘肺的并发症之一
E. 滑石尘肺的并发症之一

正确答案：C。煤矿工人尘肺的并发症之一

解析：本题考查类风湿性尘肺结节的概念。类风湿性尘肺结节（Caplan 综合征）是指煤矿工人中类风湿性关节炎的病人，在X线胸片中出现密度高而均匀、边缘清晰的圆形块状阴影，是煤矿工人尘肺的并发症之一（C对ABCD错）。